女，26岁。感冒后出现全身无力、双眼睑下垂3天。晨起症状较轻，活动后加重。对该患者不必要的检查是
A. 新斯的明试验
B. 重复神经刺激
C. 胸腺CT
D. 甲状腺功能检查
E. 肌肉活检

正确答案：E。肌肉活检

解析：患者感冒（有前驱感染症状）后出现全身无力、双眼睑下垂（肌无力症状），晨起症状较轻、活动后加重（不耐受疲劳），结合以上病史、临床表现，最有可能的诊断为重症肌无力。为明确诊断可进一步行重复神经电刺激检查（B对），90%的重症肌无力患者低频刺激时为阳性，且与病情轻重相关。重症肌无力患者胸腺重量多增加，淋巴滤泡增生，生发中心增多，胸腺CT（C对）可发现胸腺增生和肥大。5%的重症肌无力患者有甲状腺功能亢进，应行甲状腺功能检查（D对）。新斯的明为胆碱酯酶抑制剂，可使体内乙酰胆碱分解减少，新斯的明试验（A对）阳性提示重症肌无力。肌肉活检（E错，为本题正确答案）不是重症肌无力的检查方法。